镜下肝细胞广泛气球样变性，点状坏死，病变符合
A. 急性普通型肝炎
B. 慢性持续性肝炎
C. 慢性活动性肝炎
D. 急性重型肝炎
E. 亚急性重型肝炎

正确答案：A。急性普通型肝炎

解析：急性普通型肝炎（A对）镜下的病理改变以变性为主，坏死较轻。变性表现为胞质疏松和气球样变，且肝细胞内可见淤胆现象。坏死表现为肝细胞内可见点状坏死和嗜酸性小体。慢性持续性肝炎（B错）的病理改变与轻度慢性肝炎相似，即点状坏死，肝小叶界板无破坏，小叶结构清楚。慢性活动性肝炎（C错）的病理改变与中度慢性肝炎相似，即中度碎片状坏死，出现特征的桥接坏死，小叶内开始有纤维间隔形成。急性重型肝炎（D错）的病理改变是坏死重，变性轻，出现弥漫性大片坏死，小叶周边部残留少许变性的肝细胞。亚急性重型肝炎（E错）的病变特点是既有坏死也有再生，即肝细胞的大片坏死和结节状肝细胞的再生。